下列情况需要进行义齿重衬，除了
A. 义齿初戴时不贴合、固位不良时需要重衬
B. 全口义齿戴用一段时间后因牙槽嵴吸收导致固位不良
C. 义齿折断修理后导致不密合
D. 刃状牙槽嵴患者，全口义齿修复后广泛性压痛
E. 颌位关系错误

正确答案：E。颌位关系错误

解析：本题考查需要进行义齿重衬的情况。颌位关系错误（E错，为本题的正确答案）则制作的义齿不稳定，无法行使功能需要重做而不是重衬。义齿初戴时不贴合（A对）、戴用一段时间后牙槽嵴吸收（B对）、义齿折断修理后导致不密合（C对）都会使基托和组织面直接有间隙，不利于固位和稳定，都需要重衬，使其密合。对于刃状牙槽嵴患者，全口义齿修复后广泛性压痛（D对），应采用自凝软衬材料重衬，该材料柔软有弹性，可解除压痛。